患者，男，15岁，因咳嗽、咳痰发热3天入院确诊为社区获得性肺炎，给予静滴青霉素钠，10分钟后出现头昏、面色苍白、呼吸困难、血压下降等症状。对该患者首选的抢救药物是
A. 多巴胺
B. 去甲肾上腺素
C. 地塞米松
D. 肾上腺素
E. 氢化可的松

正确答案：D。肾上腺素

解析：本题考查肾上腺素。出现题干描述症状，对该患者首选的抢救药物是肾上腺素（D对）。该患者的症状是过敏性休克，肾上腺素是过敏性休克的首选药。多巴胺（A错）适用于心肌梗死、创伤、内毒素败血症、心脏手术、肾功能衰竭、充血性心力衰竭等引起的休克综合征。去甲肾上腺素（B错）作为急救时补充血容量的辅助治疗。地塞米松（C错）适用于过敏性与自身免疫性炎症性疾病。氢化可的松（E错）用于肾上腺皮质功能减退症的替代治疗及先天性肾上腺皮质功能增生症的治疗，也可用于类风湿性关节炎、风湿性发热、痛风、支气管哮喘、过敏性疾病，并可用于严重感染和抗休克治疗等。